矽肺X线胸片表现与肺部病变程度
A. 一定平行
B. 不一定平行
C. 前者重于后者
D. 后者重于前者
E. 没有关系

正确答案：B。不一定平行